按UICC的分类，唇内侧黏膜应属
A. 唇癌
B. 颊黏膜癌
C. 皮肤癌
D. 口底癌
E. 中央性颌骨癌

正确答案：B。颊黏膜癌

解析：唇癌为发生于唇红缘黏膜的癌。按UICC的分类，唇内侧黏膜应属颊黏膜癌。掌握“颊癌、口底癌及唇癌”知识点。